下肢静脉曲张患者行静脉剥脱术时，不应结扎的是
A. 旋髂浅静脉
B. 腹壁浅静脉
C. 股外侧浅静脉
D. 腹壁下静脉
E. 股内侧浅静脉

正确答案：D。腹壁下静脉

解析：下肢静脉曲张患者行静脉剥脱术时，需要结扎大隐静脉及其属支，旋髂浅静脉（A对）、腹壁浅静脉（B对）、股外侧浅静脉（C对）、股内侧浅静脉（E对）均为大隐静脉的属支。腹壁下静脉（D错，为本题正确答案）为髂外静脉的属支，故不应结扎。